下列是环境中易引起持续性蓄积危害的污染物，哪项除外
A. DDT
B. 氰化物
C. 汞
D. 镉
E. 铅

正确答案：B。氰化物

解析：本题考查环境中易引起持续性蓄积危害的污染物。持续性蓄积危害的污染物主要有两类，一类是铅（E对）、镉（D对）、汞（C对）等重金属及其化合物，另一类是脂溶性强、不易降解的有机化合物（A对），这类化合物能在环境中长期残留持久存在，在生物体内持续性蓄积，被称为持久性有机污染物。氰化物（B错，为本题正确答案）不能引起持续性蓄积危害。